办公场所环境污染物可分为
A. 化学性和生物性二类
B. 物理性和化学性二类
C. 化学性、生物性和放射性三类
D. 物理性、生物性和放射性三类
E. 物理性、化学性、生物性和放射性四类

正确答案：E。物理性、化学性、生物性和放射性四类

解析：本题考查办公场所环境污染物的分类。办公场所环境污染物的种类很多，按其属性可分为物理性、化学性、生物性和放射性污染物四大类（E对ABCD错）。物理性污染物主要包括气温、气湿、气流、辐射、采光、照明、噪声等；化学性污染物主要包括颗粒物、一氧化碳、二氧化碳、臭氧、氨、甲醛、挥发性有机物等；生物性污染物主要包括细菌、病毒、真菌、病媒生物（苍蝇、蚊子、尘螨、蟑螂等）、致敏植物花粉等；放射性污染物主要来自于建筑物中的放射性物质。